分子中含有苯甲酰胺结构，通过拮抗多巴胺D₂受体，具有促胃动力和止吐作用的药物是
A. 甲氧氯普胺
B. 盐酸昂丹司琼
C. 多潘立酮
D. 格拉司琼
E. 盐酸阿扎司琼

正确答案：A。甲氧氯普胺

解析：本题考查甲氧氯普胺。甲氧氯普胺（A对）的分子中含有苯甲酰胺结构，通过拮抗中枢和外周的多巴胺D₂受体，发挥促胃动力和止吐作用。昂丹司琼（B错）分子是由咔唑酮和2-甲基咪唑组成的拮抗5-HT₃受体的放疗与化疗止吐药物；多潘立酮（C错）为较强的外周性多巴胺D₂受体拮抗剂，止吐活性较甲氧氯普胺小；格拉司琼（D错）分子是由吲唑环和含氮双环组成的放疗与化疗止吐药；阿扎司琼（E错）是由1，4-苯并噁嗪和氮杂双环组成的放疗与化疗止吐药。